粉碎性骨折
A. 骨折处皮肤粘膜完整，骨折端不与外界相通
B. 骨折处软组织破裂，骨折端与外界相通
C. 骨折部碎成4块以上
D. 发生于肌腱附着部位的骨折
E. 骨折有移位、畸形

正确答案：C。骨折部碎成4块以上

解析：粉碎性骨折指骨质碎裂成三块以上（C对），骨折线呈T形或Y形者又称为T形或Y形骨折。骨折处皮肤粘膜完整，骨折端不与外界相通（A错）指闭合性骨折。骨折处软组织破裂，骨折端与外界相通（B错）指开放性骨折。发生于肌腱附着部位的骨折（D错）指撕脱性骨折，具体表述为由于肌肉强烈收缩，造成与肌腱相连的骨的突起和粗隆部的骨质分离。骨折有移位、畸形（E错）指不稳定骨折，具体表述为在生理外力作用下，骨折端易发生移位的骨折。